男性，40岁。20年前患过肺结核，平素体健，近3个月来有刺激性咳嗽，痰中偶有血丝，有时发热。X线示：右肺上叶前段有2.0cm×2.5cm的块状阴影，边缘不整呈分叶状，痰查脱落细胞3次均阴性，诊断首先考虑为
A. 肺结核
B. 肺脓肿
C. 肺囊肿
D. 肺癌
E. 肺良性肿瘤

正确答案：D。肺癌

解析：患者为中年男性，近三个月来有刺激性呛咳，痰中偶有血丝，肺部X线显示块状阴影，并且边缘不整，成分叶状，与周围型肺癌的临床症状与X线较为接近，根据其临床表现和辅助检查，考虑肺癌（D对）可能性较大。肺结核（P65）（A错）以发热为常见症状，多为长期午后潮热，本患者虽然20年前患过肺结核，但该患者有时发热，刺激性呛咳等临床症状，与肺结核的典型症状不符，故不应把肺结核作为首选考虑。肺脓肿（P58）（B错）常见症状为急性起病，畏寒，高热，体温达39～40℃，伴有咳嗽，咳黏液痰或黏液脓性痰，此外还有全身中毒症状，X线脓腔常出现圆形透亮区及气液平面，本患者未见明显脓痰及其他肺脓肿症状，X线与肺脓肿典型表现不符，故不首先考虑肺脓肿。肺囊肿（C错）X线影一般边缘规则，常为液气囊肿，与本病X线影像不符。肺良性肿瘤（九版外科学P269）（E错）多见于青年男性，一般不出现症状，肺部X线检查时发现，肿瘤呈圆形，椭圆形或分叶状块影，本患者有明显临床症状，故不做首先考虑。应注意本患者虽然3次痰液检查阴性，但是中央型肺癌3次以上系列痰标本阳性率达80%，周围性肺癌的痰标本阳性率达50%（八版内科学P82），有一定的假阴性率存在，所以不应以此为条件排除肺癌诊断。